脾虚之咳嗽，多表现为
A. 夜间咳甚
B. 咳声不扬
C. 咳声低微
D. 咳声重浊
E. 天亮咳甚

正确答案：E。天亮咳甚

解析：夜间咳甚为肾水亏损，肾阴不能上滋于肺，肺阴亏虚，肺失宣降所致（A错）。咳声不扬多为热邪犯肺，肺津被灼所致（B错）。咳声低微多属虚证，多为肺气虚损，失于宣降所致（C错）。咳声重浊多属实证，多为寒痰湿浊停聚于肺，肺失肃降所致（D错）。天亮咳甚多为脾虚，母病及之，肺亦虚，肺失宣降所致（E对）。